一般位于牙根的近冠方的1/3，含有密集排列的胶原纤维，方向与根面垂直，基质为小的胶原纤维束的牙骨质为
A. 无细胞无纤维牙骨质
B. 无细胞外源性纤维牙骨质
C. 有细胞固有纤维牙骨质
D. 无细胞固有纤维牙骨质
E. 有细胞混合性分层牙骨质

正确答案：B。无细胞外源性纤维牙骨质

解析：无细胞外源性纤维牙骨质一般位于牙根近冠方的1/3，含有密集排列的胶原纤维，方向与根面垂直。上皮根鞘断裂，牙本质暴露于牙囊组织后，此种牙骨质附着在新形成的牙本质表面，基质为小的胶原纤维束。掌握“牙骨质”知识点。